检查“注射液的装量”时，需使用的器具有
A. 天平
B. 注射器（干燥）
C. 经标化的量具
D. 移液管
E. 伞棚灯

正确答案：B、C。注射器（干燥）；经标化的量具